患者出现线性龈红斑时，应重点考虑的全身疾病是
A. 艾滋病
B. 掌跎角化—牙周破坏综合征
C. 梅毒
D. 糖尿病
E. 粒细胞缺乏症

正确答案：A。艾滋病

解析：本题考查艾滋病的口腔表现。患者出现线性龈红斑时，应重点考虑的全身疾病是艾滋病（A对）。艾滋病相关的牙周病损有线性龈红斑、坏死性溃疡性龈炎、坏死性溃疡性牙周炎。掌跎角化—牙周破坏综合征患者乳、恒牙萌出不久即有深牙周袋，溢脓，牙槽骨迅速吸收，后相继脱落（B错）。梅毒患者很少有累及牙周组织的病变，梅毒黏膜斑可发生在口腔黏膜的任何部位，表现为圆形或椭圆形，灰白色、光亮微隆的斑块，直径约1cm（C错）。糖尿病患者龈缘红肿呈肉芽状增生，易出血和发生牙周脓肿，牙槽骨迅速破坏，导致深袋和牙松动（D错）。粒细胞缺乏症患者牙龈多处溃疡或坏死，伴有剧烈疼痛，有坏死组织时呼吸有恶臭（E错）。